患者右侧舌肌萎缩，伸舌时舌尖偏向右侧，其病变累及
A. 左侧皮质核束
B. 右侧皮质核束
C. 左侧舌下神经核
D. 右侧舌下神经核
E. 无

正确答案：D。右侧舌下神经核

解析：一侧舌下神经核的神经元受损，可致病灶侧全部舌肌瘫痪， 表现为伸舌时舌尖偏向病灶侧，该患者右侧舌肌萎缩，伸舌时舌尖偏向右侧，因此其病变累及右侧舌下神经核（D对）。